迟发型超敏反应主要与下列哪类细胞有关
A. B细胞
B. 巨噬细胞
C. T细胞
D. NK细胞
E. 中性粒细胞

正确答案：C。T细胞